新生儿胆红素脑病早期的主要临床特征是
A. 体温升高、体重减轻
B. 呼吸困难、发绀明显
C. 肢体痉挛、角弓反张
D. 前囟隆起、骨缝分离
E. 拒乳嗜睡、肌张力低

正确答案：E。拒乳嗜睡、肌张力低

解析：新生儿胆红素脑病早期（第1期警告期）的主要临床特征是拒乳嗜睡肌张力低（E对）。体温升高体重减轻（A错）、呼吸困难发绀明显（B错）、肢体痉挛角弓反张（C错）、前囟隆起骨缝分离（D错）为第2期痉挛期的临床表现。